先将总体按某种特征分成若干个“层”，再在每个层中用随机方式抽取调查对象，再将每个层所有抽取的调查对象合成一个样本的是
A. 单纯随机抽样
B. 系统抽样
C. 分层抽样
D. 整群抽样
E. 多级抽样

正确答案：C。分层抽样

解析：分层抽样：先将总体按某种特征分成若干个“层”，再在每个层中用随机方式抽取调查对象，再将每个层所有抽取的调查对象合成一个样本，称分层抽样。掌握“口腔健康状况调查的目的、项目、标准及方法”知识点。